形成低带免疫耐受的细胞是
A. B细胞
B. T细胞
C. T、B细胞
D. 单核细胞
E. NK细胞

正确答案：B。T细胞